人血白蛋白（液体）
A. 普通库存放
B. 低温库存放
C. 阴凉库存放
D. 分库分区存放
E. 专库存放

正确答案：B。低温库存放

解析：本题考查药品的贮存。人血白蛋白为人血液制品，主要成份为人血白蛋白，不宜冷冻，应低温库存放（B对）。普通库存（A错）放的药品包括抗感染药物、利尿药、维生素等。阴凉库（C错）温度不高于20℃，贮存的药品包括抗感染药物、钙通道阻滞剂和解痉药等。药品与非药品必须分区存放（D错）。麻醉药品、一类精神药品、二类精神药品、易制毒化学品、按一类精神药品管理的处方药必须实行专库存放（E错），双人双锁管理，专帐记录。